宫内节育器的抗生育原理主要为
A. 抗孕激素
B. 抗雌激素
C. 抑制排卵
D. 阻碍受精
E. 干扰着床

正确答案：E。干扰着床

解析：IUD的抗生育作用主要是局部组织对异物的组织反应，导致子宫内膜损伤及慢性炎症反应，产生前列腺素，改变输卵管蠕动，使受精卵运行速度与子宫内膜发育不同步而影响受精卵着床（E对），抗孕激素（P384）（A错）是米非司酮终止早孕及药物流产的机制。抑制排卵（C错）（P377）为甾体激素避孕药的作用机制。阻碍受精（D错）（P381）为阴茎套、阴道套、外用杀精剂等外用避孕方法的作用机制。各种避孕措施均无抗雌激素（B错）的作用机制。